患者，女，62岁。已确诊为右乳岩，胸胁胀满，嗳气频频，纳呆懒言，口苦咽干，舌淡苔薄白，脉弦滑。其证候是
A. 肝肾不足
B. 脾胃不和
C. 情志郁结
D. 气血两亏
E. 冲任失调

正确答案：C。情志郁结

解析：肝肾不足多有腰膝酸软，眩晕耳鸣，胁痛等症状，舌质红，脉细数（A错）。脾胃不和多有恶心欲吐，食欲不振等症状，脉多细弱（B错）。患者已经诊断为乳岩，胸胁胀满，嗳气频频为情志郁结，肝郁气滞之象，纳呆懒言，口苦咽干为肝郁化火犯胃所致，舌淡苔薄白，脉弦滑符合情志郁结的舌脉，故其证候为情志郁结（C对）。气血两亏多形体消瘦，面色萎黄，头晕目眩，神倦乏力，少气懒言，脉多沉细（D错）。冲任失调多有经期紊乱，脉多弦细（E错）。